按照《戒毒药品管理办法》，下列关于戒毒药品使用管理的论述，正确的是
A. 戒毒治疗药品按处方药管理
B. 戒毒治疗辅助药品按非处方药管理
C. 戒毒用美沙酮处方要留存半年备查
D. 戒毒治疗药品按麻醉药品管理
E. 戒毒机构自行配制的戒毒药品只能在本机构内自用，不得进入市场

正确答案：A、B、E。戒毒治疗药品按处方药管理；戒毒治疗辅助药品按非处方药管理；戒毒机构自行配制的戒毒药品只能在本机构内自用，不得进入市场